针刺肌肉浅薄部位的腧穴，常用的进针法是
A. 指切
B. 夹持
C. 舒张
D. 提捏
E. 套管

正确答案：D。提捏

解析：该题考查针刺进针法。提捏进针法适用于皮肉浅薄部位的进针（D对）。指切进针法适用于短针的进针（A错）。夹持进针法适用于长针的进针（B错）。舒张进针法适用于皮肤松弛部位腧穴的进针（C错）。套管进针法多用于儿童和惧针者，也有用安装弹簧的特制进针器进针者（E错）。